对执业药师获取药物信息用处不大的软件是
A. 《IPA光盘数据库》
B. 《药物不良反应1960～1997》
C. 《中毒急救咨询系统》
D. 《全国药业上市股票咨询系统》
E. 《门诊处方药物问不良相互作用》

正确答案：B。《药物不良反应1960～1997》